人群健康水平的提高有利于
A. 出生率提高
B. 平均期望寿命提高
C. 劳动力的工作时间延长
D. 人均摄入的热量增加
E. 儿童肥胖率提高

正确答案：C。劳动力的工作时间延长